女，20岁。右颈前肿块2个月来诊。査体，甲状腺右叶上极扪及3cm×2cm肿块，表面光滑，颈部未触及肿大的淋巴结。该患者首选的检査是
A. 甲状腺B超
B. 颈部CT
C. 甲状腺核素扫描
D. 肿块针吸细胞学检查
E. 颈部正侧位X线片

正确答案：A。甲状腺B超

解析：女，20岁。右颈前肿块2个月来诊。査体，甲状腺右叶上极扪及3cm×2cm肿块，表面光滑，未明确肿块的情况首选B超（A对）。肿块针吸细胞学检查（D错）是明确甲状腺结节性质的有效方法，其准确率达80%以上，可作为和制定下一步治疗方案的方法但是不作为首选。颈部CT（B错）能显示甲状腺的病灶数目、部位、与邻近结构关系以及有无淋巴结肿大精确度高但是价格相对昂贵不作为首选。甲状腺核素扫描（C错）能够反映甲状腺局部及整体功能，能够发现甲状腺结节并进行良恶性初步鉴别，但并不能明确诊断。颈部正侧位X线片（E错）可显示软组织钙化、积气、气管形态等，一般不用于诊断甲状腺病变。